对于二尖瓣关闭不全，下列说法不正确的是
A. 风湿性损害最常见
B. 可引起左房、左室扩大
C. 第一心音多增强
D. 心功能改善时二尖瓣关闭不全亦可改善
E. 可导致左心功能衰竭

正确答案：C。第一心音多增强